体内合成脂肪酸的原料乙酰CoA主要来自
A. 氨基酸氧化分解
B. 葡萄糖氧化分解
C. 脂肪酸氧化分解
D. 胆固醇氧化分解
E. 酮体氧化分解

正确答案：B。葡萄糖氧化分解

解析：体内合成脂肪酸的原料乙酰CoA主要来自葡萄糖氧化分解（B对）。氨基酸氧化分解（A错）主要产生氨和相应的酮酸。脂肪酸氧化分解（C错）产生的乙酰CoA主要用于合成酮体。胆固醇氧化分解（D错）主要是产生胆汁酸。酮体氧化分解（E错）产生的乙酰CoA主要用于氧化供能。